治疗真菌性阴道炎可选用
A. 复方角菜酸酯栓
B. 克霉唑栓
C. 阿达帕林凝胶
D. 复方苯甲酸酊
E. 炉甘石洗剂

正确答案：B。克霉唑栓

解析：本题考查克霉唑栓。治疗真菌性阴道炎可选用克霉唑栓（B对）。真菌性阴道炎：常选用制霉菌素、克霉唑、咪康唑、益康唑栓剂，首选硝酸咪康唑栓，次选克霉唑栓。复方角菜酸酯栓（A错）用于治疗痔疮及其他肛门疾患引起的疼痛、肿胀、出血和瘙痒的对症治疗。阿达帕林凝胶（C错）用于粉刺、丘疹和脓疱为主要表现的寻常型痤疮的皮肤治疗。复方苯甲酸酊（D错）是外用抗真菌药，治疗浅表真菌感染，对体癣、股癣、手、足癣疗效好。炉甘石洗剂（E错）用于急性瘙痒性皮肤病，如湿疹和痱子。